具有杀菌作用的紫外线波长是
A. 50～90nm
B. 100～140nm
C. 150～190nm
D. 240～280nm
E. 400～490nm

正确答案：D。240～280nm

解析：紫外线波长在240～280nm均具有杀菌作用，其中以波长为265～266nm杀菌作用最强。掌握“消毒与灭菌”知识点。